国际上广泛用来判断日常生活活动能力的五项指标是
A. 进食、穿衣、洗澡、上厕所和室内走动
B. 进食、穿衣、修饰、做家务和上下床活动
C. 进食、穿衣、修饰、做家务和室内走动
D. 进食、购物、洗澡、上厕所和上下床活动
E. 进食、购物、洗澡、上厕所和室内走动

正确答案：A。进食、穿衣、洗澡、上厕所和室内走动